男性，38岁。半月前拔牙，次晨畏寒发热，咳嗽，痰量逐渐增多，呈脓性有臭味。胸片示左下肺大片阴影，有空洞。最可能的诊断是
A. 左下肺炎症
B. 左下肺脓肿
C. 左下肺结核
D. 肺癌
E. 左下肺支气管扩张症

正确答案：B。左下肺脓肿

解析：患者半月前拔牙，可能导致病原体经口、咽腔吸入肺内，病原体多为厌氧菌，导致肺部感染引起肺脓肿，表现为畏寒发热，咳嗽，痰量逐渐增多，呈脓性有臭味本（为肺脓肿的典型临床表现），例胸片示左下肺大片阴影，有空洞（为肺脓肿的典型胸片改变），根据其临床表现和辅助检查，考虑诊断为左下肺脓肿（B对）。左下肺炎症（A错）很少有脓臭痰的表现。肺结核（C错）（P64）起病缓慢，病程较长，且不会有脓臭痰。肺癌（P77）（D错）阻塞支气管常引起远端肺化脓性感染，但形成肺脓肿的病程相对较长，因有一个逐渐阻塞的过程，毒性症状多不明显，脓痰量亦较少。支气管扩张症（P37）（E错）多见于儿童和青年，主要症状为持续或反复的咳嗽、咳痰或咳脓痰，病史较长，X线胸片示典型的“双轨征”。